女性，46岁。血性白带半年就诊。检查见阴道左穹隆消失，宫颈重度糜烂，子宫正常大小，右侧附件浸润未达盆壁，宫颈活检为鳞状细胞癌。本例应选择的治疗措施为
A. 中药治疗
B. 化学药物治疗
C. 放射治疗
D. 手术治疗
E. 手术后放射治疗

正确答案：C。放射治疗

解析：46岁女性，宫颈活检为鳞状细胞癌子宫颈癌，血性白带半年就诊，检查见阴道左穹隆消失，宫颈重度糜烂，子宫正常大小，右侧附件侵润未达盆壁，可分为子宫颈癌ⅡB期，ⅡB期是放射治疗（C对）的适应证。化学药物治疗（B错）主要适用于晚期或复发转移患者和同期放化疗。手术治疗（D错）主要适用于早期子宫颈癌（ⅠA～ⅡA期）患者。中药治疗（A错）和手术后放射治疗（E错），八版妇产科学教材未明确说明。